超过有效期的药品是
A. 新药
B. 假药
C. 劣药
D. 医药商品
E. 麻醉药品

正确答案：C。劣药

解析：本题考查劣药。超过有效期的药品是劣药（C对）。根据《药品管理法》第九十八条第三款规定，有下列情形之一的，为劣药：①药品成分的含量不符合国家药品标准；②被污染的药品；③未标明或者更改有效期的药品；④未注明或者更改产品批号的药品；⑤超过有效期的药品；⑥擅自添加防腐剂、辅料的药品；⑦其他不符合药品标准的药品。新药（A错）系指未曾在中国境内上市销售的药品。有下列情形之一的，为假药（B错）：①药品所含成分与国家药品标准规定的成分不符的；②以非药品冒充药品或者以他种药品冒充此种药品的。有下列情形之一的药品，按假药论处：①国务院药品监督管理部门规定禁止使用的；②依照本法必须批准而未经批准生产、进口，或者依照本法必须检验而未检验即销售的；③变质的；④被污染的；⑤使用依照本法必须取得批准文号而未取得批准文号的原料药生产的；⑥所表明的适应症或者功能主治超出规定范围的。麻醉药品（E错）是指连续使用后易产生身体依赖性、能成瘾癖的药品。